以下有关面神经的叙述中，正确的是
A. 是运动神经
B. 是感觉神经
C. 经圆孔出颅
D. 以茎乳孔为界，可分为三段
E. 支配表情肌的运动

正确答案：E。支配表情肌的运动

解析：面神经为混合性神经，含有三种纤维，即运动纤维、副交感纤维和味觉纤维。面神经穿内耳道入面神经管，经茎乳孔出颅。向前穿过腮腺，呈扇形分布于面部表情肌。以茎乳孔为界，可将面神经分为面神经管段和颅外段。掌握“面神经、舌咽神经、舌下神经的分支与分布”知识点。